代谢后产生丙烯醛，引起膀胱毒性的药物是
A. 卡莫司汀
B. 氟尿嘧啶
C. 环磷酰胺
D. 巯嘌呤
E. 盐酸阿糖胞苷

正确答案：C。环磷酰胺

解析：本题考查环磷酰胺的不良反应。代谢后产生丙烯醛，引起膀胱毒性的药物是环磷酰胺（C对）。环磷酰胺本身无毒性，代谢后产生的丙烯醛会导致膀胱黏膜急性或慢性损伤，引进化学性炎症，造成膀胱广泛的出血，引起出血性膀胱炎。卡莫司汀（A错）最严重的不良反应是延迟性和累积性骨髓抑制，用药期间应定期检查血象。氟尿嘧啶（B错）的不良反应主要为对骨髓和胃肠道的毒性。巯嘌呤（D错）主要毒性为骨髓抑制。盐酸阿糖胞苷（E错）有白细胞减少、血小板减少和巨幼红细胞性贫血等骨髓抑制，恶心、呕吐亦为常见。